与基础代谢无关的因素是
A. 年龄
B. 体力劳动强度
C. 体型
D. 性别
E. 气温

正确答案：B。体力劳动强度